关于异丙肾上腺素的作用叙述错误的是
A. 正性肌力和正性频率作用
B. 禁用于甲状腺功能亢进者
C. 激动支气管平滑肌的β₂受体
D. 激动血管平滑肌的β₂受体
E. 升高血糖作用比肾上腺素强

正确答案：E。升高血糖作用比肾上腺素强

解析：异丙肾上腺素药理作用：①兴奋心脏：对β₁受体具有强大的激动作用，表现为正性肌力和正性频率作用（A对）。②影响血压：激动血管平滑肌的β₂受体（D对），骨骼肌血管明显扩张，肾和肠系膜血管和冠状血管不同程度扩张，外周总阻力下降。③舒张支气管：激动β₂受体，有强大的舒张支气管平滑肌作用（C对）。④促进代谢激动β受体。促进糖和脂肪的分解，增加组织耗氧量。升高血糖作用比肾上腺素弱（E错，为本题正确答案）。不良反应：禁用于冠心病、心肌炎和甲状腺功能亢进病人（B对）。